疱疹性咽峡炎的最常见的病原体是
A. 流感病毒
B. 副流感病毒
C. 柯萨奇病毒
D. 单纯疱疹病毒
E. 腺病毒

正确答案：C。柯萨奇病毒

解析：本题为记忆题。疱疹性咽峡炎是由肠道病毒引起的疾病。特征为急起的发热和喉痛，在软腭的后部、咽、扁桃体等处可见红色的晕斑，周围有特征性的水疱疹或白色丘疹（淋巴结节）。大多数为轻型病例，有自限型（1～2周）。疱疹性咽峡炎最常见的病原体是柯萨奇病毒（C对）。